临床最常见的头痛伴剧烈呕吐多提示为
A. 偏头痛
B. 癫痫
C. 椎-基底动脉供血不足
D. 神经功能性头痛
E. 颅内高压

正确答案：E。颅内高压

解析：本题考查头痛的伴随症状。临床最常见的头痛伴剧烈呕吐多提示为颅内高压（E对）。偏头痛（A错）常表现为头痛在呕吐后减轻。癫痫（B错）是多种原因导致的脑部神经元高度同步化异常放电所致的临床综合征，临床表现具有发作性、短暂性、重复性和刻板性的特点；异常放电神经元的位置不同及异常放电波及的范围差异，导致患者的发作形式不一，可表现为感觉、运动、意识、精神、行为、自主神经功能障碍或兼有之。椎-基底动脉供血不足（C错）常表现为头痛伴眩晕。神经功能性头痛（D错）常表现为头痛伴神经功能紊乱。